苯妥英钠所致的牙龈增生发生在服药后
A. 1～3个月
B. 1～6个月
C. 3～6个月
D. 6个月后
E. 1年后

正确答案：B。1～6个月

解析：苯妥英钠所致的牙龈增生一般开始于服药后的1～6个月内。掌握“药物性牙龈肥大”知识点。